女，53岁，3月前坐长途火车时突然出现不认识女儿，并对空气大喊“有蜘蛛”，并出现各种兴奋症状，手舞足蹈，经治疗后好转。1周前得知儿子意外死亡后，感觉总能看到儿子，感觉自责，后面还想要自杀解脱。。既往有高血压五年，200/90mmHg。查定向障碍，视幻觉，思维不连贯。高血压加重时症状加重。应诊断为
A. 双向障碍
B. 精神分裂症
C. 脑血管病引起的精神障碍
D. 躯体疾病引起的精神障碍
E. 急性应激障碍

正确答案：C。脑血管病引起的精神障碍

解析：血管疾病时伴发的精神障碍临床表现：（1）焦虑、紧张：最多见；（2）幻觉妄想状态：在血液循环障碍严重时偶可出现幻听，常为议论性和命令性。妄想多为被害性；（3）意识障碍：有失神、晕厥发作，症状出现前常先有心前区轻度疼痛，后无力、恶心，继而出现黑蒙、短暂的意识丧失。常见于心绞痛、心律失常和心肌梗死时；（4）抑郁状态。血管疾病伴发的精神障碍可出现幻觉、妄想（C对）。